能增强磺胺类药物抗菌作用的药物
A. 呋喃唑酮
B. 甲氧苄氨嘧啶
C. 氧氟沙星
D. 磺胺嘧啶
E. 甲硝唑

正确答案：B。甲氧苄氨嘧啶

解析：磺胺嘧啶（D错）本身就属于磺胺类药物，可与PABA竞争二氢叶酸合成酶，妨碍二氢二酸的合成，进而影响核酸的合成，从而抑制细菌的生长繁殖，甲氧苄氨嘧啶（B对）属于二氢叶酸还原酶抑制剂，阻碍四氢叶酸的合成，与磺胺合用可使细菌叶酸代谢受到双重阻断，抗菌作用增加数倍至数十倍，甚至出现杀菌作用，且可减少耐药的产生。呋喃唑酮（A错）属于硝基呋喃类抗菌药，其作用机制为干扰细菌氧化还原酶从而阻断细菌的正常代谢，对革兰阳性菌及阴性菌均有一定的抗菌作用，不能增效磺胺类药效。氧氟沙星（C错）属于喹诺酮类人工合成的抗生素，主要是抑制细菌的DNA回旋酶和拓扑异构酶Ⅳ，导致DNA复制和转录错误，引起细菌死亡，与磺胺类抗菌药之间无明显药物相互作用。甲硝唑（E错）在体内还原为硝基阴离子等细胞毒物质，损害虫体DNA螺旋结构，阻止DNA和RNA的合成，杀灭原虫。